下列哪项最不符合成釉细胞瘤的X线特征
A. 肿瘤内多见钙化影
B. 多房型可见分房大小相差悬殊
C. 骨质膨胀，以向唇颊侧为甚
D. 肿瘤可含牙或不含牙，邻牙可被肿瘤推压而移位
E. 牙根可被侵蚀呈锯齿状或截断状

正确答案：A。肿瘤内多见钙化影

解析：成釉细胞瘤的影像学表现为：①多房型在成釉细胞瘤中最多见，分房大小不等，成群排列，相互重叠，肿瘤处的牙根截断壮吸收，相邻牙齿也被分开；②单房型较多房型少见，为一个单房状低密度影像，边缘呈分叶状，有切迹，瘤内可以含牙；③蜂窝型为大小基本相等的小分房，房隔厚且粗糙不规则，肿瘤边缘清晰，且肿瘤内可以含牙；④局部恶性征型最为少见，影像表现为颌骨无膨胀改变，但颌骨骨小梁和密质骨溶解消失，颌骨外形消失。但是瘤内不含钙化影。掌握“成釉细胞瘤”知识点。